某医院抽样调查100名健康人血清。求得平均数为4.800，标准差为0.7920，求其标准误为
A. 0.0792
B. 0.792
C. 0.0079
D. 0.048
E. 7.92

正确答案：A。0.0792

解析：根据题意，本题属于标准误的计算，标准误即均数的抽样误差。由计算公式为：σ`x=σ/√n 可知，标准误=0.7920/√100=0.0792（ A对）。